关于青霉素钠中青霉素聚合物的检查，叙述正确的有
A. 因为聚合物杂质可引起过敏反应
B. 用葡聚糖凝胶G-10为固定相
C. 以青霉素对照品作为对照
D. 检测波长为254nm
E. 聚合物杂质的限量为5.0%

正确答案：A、B、C、D。因为聚合物杂质可引起过敏反应；用葡聚糖凝胶G-10为固定相；以青霉素对照品作为对照；检测波长为254nm